片剂制备中压力过大会造成
A. 裂片
B. 黏冲
C. 片重差异超限
D. 均匀度不符合要求
E. 崩解超限或溶出速度降低

正确答案：E。崩解超限或溶出速度降低

解析：本题考查片剂制备中的常见问题及原因。片剂在制备中压力过大会造成崩解超限或溶出速度降低（E对）。片剂的压力过大，导致内部空隙小，影响水分渗入，导致片剂崩解迟缓或崩解超限；产生裂片（A错）的原因有物料中细粉太多、物料的塑性差，结合力弱等；黏冲（B错）的主要原因是颗粒不够干燥、物料较易吸湿、润滑剂选用不当或用量不足、冲头表面锈蚀、粗糙不光或刻字等；片重差异超限（C错）原因是物料的流动性差、物料中细粉太多或颗粒大小相差悬殊等；影响崩解的主要原因是片剂的压力过大、增塑性物料或黏合剂使片剂的结合力过强、崩解剂性能较差，混合不均匀或可溶性成分迁移可能使片剂含量不均匀，均匀度不符合要求（D错）。